某女，32岁。气血两虚、气滞血瘀致月经错后、经水淋沥不净、神疲乏力。宜选用的中成药是
A. 少腹逐瘀丸
B. 益母草颗粒
C. 固经丸
D. 宫血宁胶囊
E. 女金丸

正确答案：E。女金丸

解析：本题考查女金丸的主治。宜选用的中成药是女金丸（E对）。女金丸【功能】益气养血，理气活血，止痛。【主治】气血两虚、气滞血瘀所致的月经不调，症见月经提前、月经错后、月经量多、神疲乏力、经水淋漓不净、行经腹痛。少腹逐瘀丸（A错）（颗粒、胶囊）【功能】温经活血，散寒止痛。【主治】寒凝血瘀所致的月经后期、痛经、产后腹痛，症见行经后错、经行小腹冷痛、经血紫黯、有血块、产后小腹疼痛喜热、拒按。益母草颗粒（B错）（膏、胶囊、片、口服液）【功能】活血调经。【主治】血瘀所致的月经不调、产后恶露不绝，症见经水量少、淋沥不净，产后出血时间过长；产后子宫复旧不全见上述证候者。固经丸（C错）【功能】滋阴清热，固经止带。【主治】阴虚血热所致的月经先期，症见经血量多、色紫黑；以及赤白带下。宫血宁胶囊（D错）【功能】凉血止血，清热除湿，化瘀止痛。【主治】血热所致的崩漏下血、月经过多，产后或流产后宫缩不良出血及子宫功能性出血，以及慢性盆腔炎属湿热瘀结所致者，症见少腹痛、腰骶痛、带下增多。